地高辛加强心肌收缩力的主要机制是
A. 抑制血管紧张素转化酶
B. 上调β受体
C. 排Na⁺利尿，减少血容量
D. 抑制磷酸二酯酶Ⅲ
E. 抑制Na⁺，K⁺-ATP酶

正确答案：E。抑制Na⁺，K⁺-ATP酶